DNA上的外显子是
A. 不被转录的序列
B. 被转录，但不被翻译的序列
C. 被转录也被翻译的序列
D. 调节基因序列
E. 以上都不对

正确答案：C。被转录也被翻译的序列

解析：DNA上的外显子可以被转录而出现在成熟mRNA分子中，成熟mRNA分子可以翻译成蛋白质，因此外显子是被转录也被翻译的序列（C对）；DNA上的内含子可以被转录而出现在hnRNA分子中，在RNA剪接过程中被去除的部分，因此内含子是被转录但不被翻译的序列（B错）。调节基因序列（D错）是一段控制基因表达的DNA片段，是不被转录的序列（A错）。